女性，30岁，4小时前跌伤后昏迷5分钟，清醒后步行回家。1小时前因剧烈头痛，呕吐3次送来急诊。查体：昏迷，P64次/分，BPl80/90mmHg，R18次份，左瞳3mm，右瞳2mm，右上下肢肌力Ⅲ级。诊断应考虑
A. 脑震荡
B. 脑挫伤
C. 急性硬膜外血肿
D. 急性硬膜下血肿
E. 急性脑内血肿

正确答案：C。急性硬膜外血肿

解析：青年女性患者，跌伤后昏迷5分钟，清醒后再次昏迷（硬膜外血肿的典型表现），伴剧烈头痛、呕吐（颅内压增高的表现）。查体：左瞳3mm，右瞳2mm（双侧瞳孔大小不等，提示存在动眼神经受压），右上下肢肌力Ⅲ级（提示左侧脑功能区受压），结合患者病史、症状和查体，应考虑为左侧急性硬膜外血肿（C对）伴小脑扁桃体疝。脑震荡（P188）（A错）的典型表现为伤后即可发生的短暂意识丧失（一般不超过半小时）和近事遗忘，神经系统查体多无明显阳性体征。脑挫裂伤（P188）（B错）主要表现为头痛、恶心、呕吐和伤后立即发生的意识障碍，无中间清醒期。急性硬膜下血肿（P192）（D错）也以颅内压增高和意识障碍为主要表现，多为持续性或进行性加重的昏迷状态，多伴有瞳孔的改变。脑内血肿（P194）（E错）主要表现为进行性加重的意识障碍，常与急性硬膜下血肿同时存在。